智商IQ的结论“高于平常”，是指其分数为
A. 70～79
B. 80～89
C. 90～109
D. 110～119
E. 120～129

正确答案：D。110～119

解析：此试题取材于老版教材，根据第6版医学心理学P84智力水平的分级表，平常IQ值为85～115。因而，本题D、E均为正确选项。智商水平的分级：天才145～ 160，极超常130～145，超常115～130，平常85～115，边界70～85，轻度智力低55～70，中度智力低下40～55，重度智力低下25～40，极重度智力低下＜25。